对腹部实质性脏器病变，最简便易行的检查方法是
A. X线摄片
B. CT扫描
C. 同位素扫描
D. B型超声波检查
E. 纤维内镜检查

正确答案：D。B型超声波检查

解析：对腹部实质性脏器病变，最简便易行的检查方法是B型超声波检查（D对）。X线摄片可作为骨折等的首选（A错）。CT扫描也可用于腹部实质性脏器的检查，但不如B超简便易行，且价格昂贵，故不作为首选（B错）。同位素扫描主要用于甲状腺、脑等脏器疾病的诊断，但对腹部实质性脏器不常用（C错）。纤维内镜检查主要用于空腔脏器的检查（E错）。